下述哪一项不是早期休克临床表现
A. 烦燥不安
B. 皮肤苍白发凉
C. 脉搏细速
D. 血压和脉压差正常
E. 尿量减少

正确答案：D。血压和脉压差正常

解析：早期休克临床表现为皮肤苍白发凉（B对），四肢湿冷，出冷汗，脉搏细速（C对），脉压减小（D错，为本题正确答案），尿量减少（E对），烦躁不安（A对），血压可骤降（如大失血），也可略降，甚至因代偿作用可正常或轻度升高，但是脉压会明显缩小，患者脏器有效灌流量明显减少。